原发性慢性肾上腺皮质功能减退症典型体征是
A. 皮肤紫纹
B. 轻度肥胖
C. 皮肤粘膜色素沉着
D. 皮肤多汗及低热
E. 脉率增快

正确答案：C。皮肤粘膜色素沉着

解析：原发性慢性肾上腺皮质功能减退症患者血皮质醇降低，对腺垂体分泌ACTH负反馈性抑制作用减弱，ACTH、黑素细胞刺激素分泌增多，二者均有刺激黑素细胞分泌色素的作用，导致皮肤粘膜色素沉着（C对），此为原发性慢性肾上腺皮质功能减退症的典型体征。皮肤紫纹（A错）为库欣综合征的典型表现。轻度肥胖（B错）可见于正常人，无特异性。皮肤多汗及低热（D错）、脉率增快（E错）多见于甲亢、皮质醇增多症及植物神经紊乱等，原发性慢性肾上腺皮质功能减退症患者少见。